下列哪项不是引起低容量性低钠血症的原因？
A. 长期持续使用速尿或利尿酸
B. 肾上腺皮质功能亢进
C. 慢性间质性肾疾患
D. 消化道失液（呕吐，腹泻）
E. 大量出汗和大面积烧伤

正确答案：B。肾上腺皮质功能亢进

解析：低容量性低钠血症即低渗性脱水。长期持续使用速尿或利尿酸（A对）能抑制髓拌升支对Na＋的重吸收，使血钠降低，导致低钠血症。慢性间质性肾疾患（C对）时肾脏重吸收功能受损，Na＋排出增多，出现低钠血症。消化道失液（D对）、大量出汗、大面积烧伤（E对）时若只补充水分则可造成细胞外液低渗引起低渗性脱水。肾上腺皮质功能不全由于醛固酮分泌不足，肾小管对钠的重吸收减少可引起低渗性脱水。肾上腺皮质功能亢进（B错，为本题正确答案）可引起高渗性脱水。